塑料全冠最常见的适应证是
A. 前牙永久修复
B. 固定义齿固位体
C. 后牙永久修复
D. 各种美容修复
E. 保护性暂时修复

正确答案：E。保护性暂时修复

解析：本题考查塑料全冠的适应证。塑料全冠最常见的适应证是保护性暂时修复（E对），可作为暂时冠起到暂时保护、隔绝外界刺激、恢复形态与功能、维持与稳定、保持自洁和提供诊断信息等作用。塑料全冠由于其抗磨损的性能较差，通常不作为永久性修复体，尤其是后牙承受咬合力较大时，而前牙在对于咬合功能要求不高且患者经济条件不允许的情况下，可适当选作塑料全冠，但需严格掌握适应症，所以前牙永久修复（A错）、后牙永久修复（C错）均不是塑料全冠最常见适应症。固位体材料的加工性能、机械强度、化学性能及生物相容性应良好，应经久耐用，不易腐蚀和变色等，因此不适宜用塑料全冠修复（B错）。由于金属的美容效果欠佳，前牙的美容修复也可用到塑料全冠，但仍需严格把握适应症且易于磨损，故并不常用（D错）。